主动转运的特点是
A. 药物由高浓度区域向低浓度区域扩散
B. 需要能量
C. 借助于载体使非脂溶性药物由高浓度区域向低浓度区域扩散
D. 小于膜孔的药物分子通过膜孔进入细胞膜
E. 黏附于细胞膜上的某些药物随着细胞膜向内凹陷进入细胞内

正确答案：B。需要能量

解析：本题考查药物的转运方式。主动转运是指药物借助载体或酶促系统，由膜的低浓度一侧向高浓度一侧转运的过程（AC错），需要消耗能量（B对）；小于膜孔的药物分子通过膜孔进入细胞膜（D错）为膜孔转运；黏附于细胞膜上的某些药物随着细胞膜向内凹陷（E错）进入细胞内称为胞饮。